乳癖消胶囊主治
A. 痰湿互结所导致的瘰疬
B. 热毒蕴结所致的疮疡
C. 痰热互结所导致的乳癖，乳核
D. 脾肾两虚，痰瘀互结所导致的阴疽
E. 痰气互结所导致的瘰疬

正确答案：C。痰热互结所导致的乳癖，乳核

解析：本题考查的是乳癖消胶囊的主治。乳癖消胶囊主治痰热互结所导致的乳癖，乳核（C对）。乳癖消胶囊：【主治】痰热互结所致的乳癖、乳痈，症见乳房结节、数目不等、大小形态不一、质地柔软，或产后乳房结块、红热疼痛；乳腺增生、乳腺炎早期见上述证候者。内消瘰疬丸：【主治】痰湿凝滞所致的瘰疬（A错），症见皮下结块、不热不痛。小儿化毒散：【主治】热毒内蕴、毒邪未尽所致的口疮肿痛、疮疡（B错）溃烂、烦躁口渴、大便秘结。小金丸：【主治】痰气凝滞所致的瘰疬（E错）、瘿瘤、乳岩、乳癖，症见肌肤或肌肤下肿块一处或数处、推之能动，或骨及骨关节肿大、皮色不变、肿硬作痛。主治为脾肾两虚，痰瘀互结所导致的阴疽（D错）的中成药，2022年考试指南未明确说明。